病人在回答问题时对前一个问题的答案要重复多次才能转入后一个问题。该症状为
A. 赘述症
B. 持续言语
C. 模仿言语
D. 刻板言语
E. 思维散漫

正确答案：B。持续言语

解析：该病人回答问题时对前一个问题的答案要重复多次才能转入后一个问题（思维活动在某一概念停滞不前）为持续言语（B对）。赘述症表现为对某种事物做不必要的过分的详尽的描述，言语啰嗦，但最终能够回答出有关问题（A错）。模仿言语是指刻板地模仿周围人的言语（C错）。刻板言语是指思维在原地踏步，概念转换困难，并且脑中概念相对较少，表现机械地、刻板地重复一些没有意义的词或句子（D错）。思维散漫表现为缺乏主题，别人都不理解他所要阐述的主题思想是什么（E错）。